医药经营企业药品质量验收记录保存
A. 三年
B. 产品有效期后一年
C. 两者都是
D. 两者都不是

正确答案：D。两者都不是

解析：本题考查医药经营企业药品质量验收记录保存时间。医药经营企业药品质量验收记录至少保存5年（D对）。企业应当制定药品采购、收货、验收、储存、养护、销售、出库复核、运输等环节及计算机系统的操作规程，记录及凭证应当至少保存5年。